男，28岁。车祸后胸痛、呼吸困难40分钟。曾咳出少量血痰，无恶心、呕吐，无腹胀、腹痛，无意识障碍。查体：P118次/分，R22次/分，BP90/60mmHg。气管右偏，左侧胸壁皮肤淤青，无皮下气肿，左侧4、5、7肋骨触痛明显，可触及骨擦感，左胸叩诊鼓音，呼吸音减弱，心律齐，未闻及心脏杂音。腹软，无压痛，肝脾肋下未触及。四肢活动尚可，病理反射未引出。辅助检查:Hb100g/L，RBC3.2×10¹²/L.胸部X线片示左侧4、5、7肋骨折，左侧气胸，肺组织压缩约70%，左侧胸腔中等量积液。需要立即给与的处理是
A. 加压包扎固定胸壁
B. 胸腔闭式引流
C. 静脉输血
D. 剖腹探查
E. 穿刺排气减压

正确答案：B。胸腔闭式引流

解析：患者青年男性，车祸后胸痛、呼吸困难40分钟。曾咳出少量血痰，无恶心、呕吐，无腹胀、腹痛，无意识障碍。查体：P118次/分（正常值60～100次/分，心律偏快），R20次/分（正常12～20次/分，呼吸偏快），BP90/60mmHg（正常值90～120/60～90mmHg，血压偏低）。气管右偏，左侧胸壁皮肤淤青（出血可能），无皮下气肿，左侧4、5、7肋骨触痛明显，可触及骨擦感（肋骨骨折），左胸叩诊鼓音（气胸），呼吸音减弱，心律齐，未闻及心脏杂音。腹软，无压痛，肝脾肋下未触及。四肢活动尚可，病理反射未引出。辅助检查：Hb100g/L（男性正常值＞120g/L），RBC3.2×10¹²/L（男性正常值4～5.5×10¹²/L），胸部X线片示左侧4、5、7肋骨折，左侧气胸，肺组织压缩约70％，左侧胸腔中等量积液（考虑血胸可能）。综合患者体征，实验室检查及影像学检查，考虑诊断为血气胸，需要立即给与的治疗的胸腔闭式引流（B对）。加压包扎固定胸壁（A错）适用于单纯肋骨骨折。静脉输血（C错）为补充血容量，适用于血红蛋白低于60g/L的患者。剖腹探查（D错）为腹部外伤暴力撞击后的治疗选择，主要看是否有腹腔内脏破裂出血。穿刺排气减压（E错）是院前或院内用来快速治疗张力性气胸的，张力性气胸的特点是皮下气肿，该患者无皮下气肿，故排除张力性气胸。